指出百分位数法评价发育水平时，哪些描述是错误的
A. 在大数量调查的基础上，计算各指标的百分位数
B. 可以用百分位数法划分发育等级
C. 可以制成某指标的百分位数图
D. 在百分位数图上可观察儿童的发育变化
E. 能看出身体发育的匀称度

正确答案：E。能看出身体发育的匀称度

解析：本题考查百分位数的相关内容。身体发育的匀称度可应用回归分析方法或指数法（E错，为本题正确答案），表示人体各部分之间的比例和相互关系，判断儿童营养状况、体型和体质。百分位数法是将某一组变量值（如体重、身高）按从小到大的顺序排列，将最小值与最大值分为100个等份，每一等份为一个百分位，按从小到大顺序确定各百分位的数值（A对）；一般是利用均值加减标准差或直接用百分位数表（B对）进行分级，根据工作内容可将测量数值分三等、五等、六等级；可通过某指标的百分位数，绘制相应的百分位数图（C对），以观察儿童的发育变化（D对）。